某人研究新生儿黄疸的病因，选择100例确诊的新生儿黄疸病例，和同期同医院确诊的没有黄疸的新生儿100例，然后调查产母的分娩卡片，了解产前及产时各种暴露情况。这种研究方法是
A. 病例对照研究
B. 群组研究
C. 临床随访研究
D. 干预性研究
E. 横断面研究

正确答案：A。病例对照研究

解析：本题考查病例对照研究的概念。病例对照研究（A对BCDE错）是以当前已经确诊的患有某特定疾病的一组病人作为病例组，以不患有该病但具有可比性的一组个体作为对照组，通过询间、实验室检查或复查病史，搜集研究对象既往对各种可能的危险因素的暴露史，测量并采用统计学检验，比较病例组与对照组各因素暴露比例的差异是否具有统计学意义，然后评估各种偏倚对研究结果的影响，并借助病因推断技术，判断某个或某些暴露因素是否为疾病的危险因素，从而达到探索和检验病因假说的目的。